口服难吸收，用于肠道感染的药物是
A. 甲氧苄啶
B. 磺胺多辛
C. 呋喃唑酮
D. 磺胺嘧啶
E. 环丙沙星

正确答案：C。呋喃唑酮